发病率、患病率与病程三者的正确关系是
A. 发病率＝患病率×病程
B. 患病率＝发病率×病程
C. 发病率＝患病率＋病程
D. 发病率＝患病率－病程
E. 病程＝发病率×患病率

正确答案：B。患病率＝发病率×病程

解析：本题考查患病率、发病率和病程三者的关系。当某病的发病率和该病的病程在相当长时间内保持稳定时患病率取决于两个因素，即发病率和病程。患病率、发病率和病程三者的关系是：患病率＝发病率×病程（B对ACDE错）。